异维A酸的不良反应不包括
A. 皮肤感染
B. 致畸作用
C. 光敏反应
D. 皮肤干燥、脱皮
E. 头痛、关节痛

正确答案：A。皮肤感染

解析：本题考查异维A酸的不良反应。皮肤感染（A错，为本题正确答案）不是异维A酸的不良反应。口服异维A酸后，皮肤或黏膜可出现干燥、脱皮（D对）、鼻出血、头痛、肌肉与关节痛（E对）、偶见过敏反应及光敏反应（C对）。妊娠期妇女服后可致自发性流产及胎儿发育畸形（B对）。